男，82岁，有多年冠心病病史。夜间睡觉时突发胸闷，端坐呼吸，查体：R35次/分，BP80/50mmHg，双肺可闻及湿啰音，心率102次/分。应对该患者立即进行什么治疗
A. 同步直流电复律
B. 异丙肾上腺素
C. 静脉泵多巴酚丁胺
D. 静脉泵多巴胺
E. 去甲肾上腺素

正确答案：C。静脉泵多巴酚丁胺

解析：老年男性，冠心病病史。夜间突发胸闷、端坐呼吸，查体：呼吸急促、心率加快、血压下降、双肺湿啰音，符合左心衰临床表现。考虑：心源性休克、急性左心衰竭、急性冠脉综合征(?) A项，患者血压80/50mmHg，但无心电图资料，无法判断是否合并心律失常，不应电复律。（A错）B项，异丙肾上腺素禁用于急性心梗，患者冠心病病史，应完善心电图及心肌酶等相关检查，排除急性心梗后方可使用。（B错）C项，多巴酚丁胺为正性肌力药，且对心率无明显影响，适用于心源性休克，静脉泵的应用又减少了心衰患者的液体入量。（C对）D项，患者BP80/50mmHg，心率102次／分，应用多巴胺可导致患者心率加快，增加心肌耗氧，诱发或加重患者冠心病。（D错）E项，去甲肾上腺素通过收缩外周血管起升压作用，患者血压下降为急性左心衰所致，使用去甲肾上腺素会增加心脏后负荷，可能加重患者病情。（E错）